毒蛇咬伤后，如为神经毒，其中医名称是
A. 火毒
B. 风毒
C. 风火毒
D. 热毒
E. 湿毒

正确答案：B。风毒

解析：蛇毒的有毒成分及毒性十分复杂，按其作用性质可分为神经毒、血液毒和酶类毒，神经毒中医称为风毒（B对），血液毒中医称为火毒（A错），蛇酶种类较多，其中蛋白水解酶、透明质酸酶相当于中医的“火毒”，磷脂酶A相当于中医的“风火毒”（C错）。